司可巴比妥为
A. 一类精神药品
B. 二类精神药品
C. 麻醉药品
D. 毒性药品
E. 放射性药品

正确答案：A。一类精神药品